异丙肾上腺素的药理作用是
A. 收缩瞳孔
B. 减慢心脏传导
C. 松弛支气管平滑肌
D. 升高舒张压
E. 增加糖原合成

正确答案：C。松弛支气管平滑肌